葡萄糖顺浓度梯度跨膜转运依赖于细胞膜上的
A. 脂质双分子
B. 紧密连接
C. 通道蛋白
D. 载体蛋白
E. 钠泵

正确答案：D。载体蛋白